盒形洞的基本特点，下列哪一条是错误的
A. 洞底要平
B. 线角要圆钝
C. 要有一定深度
D. 应制备鸠尾扣

正确答案：D。应制备鸠尾扣

解析：本题考查盒状洞形。鸠尾扣是鸠尾的一个基本结构，其作用是防止充填体水平脱位（D错，为本题的正确答案）。盒形洞的基本特点：洞底要平（A对），侧壁平面与洞底垂直，点、线角要圆钝（B对），使咬合力分布均匀，以免产生应力集中。盒形洞要有一定的深度，以获得足够的抗力（C对）。